25岁，停经10周，阴道少量流血1周，大量流血3天。伴下腹胀痛，昨日起有畏寒发热，查血压80/60mmHg，脉搏120次/分，面色苍白，神清，阴道有活动性流血，子宫如孕50天大，软，宫口松，可容1指，宫口外仍有组织堵塞，子宫压痛明显，双侧穹隆未触及肿块，但有压痛。血红蛋白80g/L，白细胞18×109/L，中性85％，除立即抗休克抗炎治疗外，应作何恰当处理
A. 立即钳夹出残留之胚胎组织
B. 3天后再行剖宫术
C. 立即行刮宫术
D. 立即静滴催产素
E. 静点止血药

正确答案：A。立即钳夹出残留之胚胎组织

解析：本例诊断为流产合并感染。流产合并感染时，切不可全面搔刮宫腔，以免造成感染扩散。故选A。掌握“自然流产”知识点。